服药期间饮酒可引起低血糖反应的是
A. 格列本脲
B. 硫酸亚铁
C. 维生素D
D. 西咪替丁
E. 左旋多巴

正确答案：A。格列本脲

解析：本题考查饮食对药物疗效的影响。口服降糖药格列本脲（A对）时忌饮酒，因酒可降低血糖水平，同时加速对中枢神经的抑制。服用硫酸亚铁（B错）期间饮酒会加重铁剂的胃肠道不良反应。饮酒对维生素D（C错）水平影响尚不清楚。服用西咪替丁（D错）期间饮酒会引起急性或慢性酒精中毒。左旋多巴（E错）服用期间饮酒会加强中枢神经系统的不良反应。以上四种药物服用时饮酒无明显降血糖作用。